属于严格的季节性的是
A. 2017年6月台湾省某市某小学和中学共169名学生发生食物中毒
B. 我国北方地区流行性乙型脑炎发病高峰在夏秋季
C. 1965年前我国大中城市人群中麻疹每隔-年流行一次
D. 近年来，猩红热的发病率与死亡率均有明显下降
E. 细菌性痢疾多见于夏秋季

正确答案：B。我国北方地区流行性乙型脑炎发病高峰在夏秋季

解析：本题考查严格的季节性。在某些地区以虫媒传播的传染病发生有严格的季节性，发病多集中在少数几个月内，其余月份没有病例的发生，如我国北方地区流行性乙型脑炎发病高峰在夏秋季（B对ACDE错）。